典型霍乱患者，发病后最先出现的症状是
A. 畏寒、发热
B. 声音嘶哑
C. 剧烈腹泻，继之呕吐
D. 腹部绞痛
E. 腓肠肌痉挛

正确答案：C。剧烈腹泻，继之呕吐

解析：典型霍乱患者，发病后最先出现的症状是剧烈腹泻，继之呕吐（C对），其特点为无发热（A错）、无里急后重感，多数不伴腹痛（D错）。声音嘶哑（B错）、腓肠肌痉挛（E错）是霍乱脱水期的表现，不是最先出现的症状。